病原菌经局部入血，但未在其中繁殖称为
A. 败血症
B. 毒血症
C. 内毒素血症
D. 脓毒血症
E. 菌血症

正确答案：E。菌血症